下列说法哪种是正确的
A. 人群易感性增高，必须导致疾病流行
B. 人群人口数增多，则人群易感性升高
C. 人群易感性降低，则流行即可停止
D. 人群易感性增高，只是为一次流行或爆发准备了条件

正确答案：D。人群易感性增高，只是为一次流行或爆发准备了条件

解析：本题考查人群易感性对传染病传播的影响。当人群易感性较高时，传染病易于发生和传播，为一次流行或暴发准备了条件（D对），而未必一定发生疾病的流行（A错）。人群易感性与人口数的多少无明确关系（B错）。人群易感性降低有利于阻断疾病的传播和流行，但未必会使疾病即刻停止（C错）。